口服后在肠道和肝脏水解成为更昔洛韦而发挥抗疱疹病毒作用的药物是
A. 昔多福韦
B. 喷昔洛韦
C. 伐昔洛韦
D. 泛昔洛韦
E. 伐更昔洛韦

正确答案：E。伐更昔洛韦

解析：本题考查药物的作用机制。口服后在肠道和肝脏水解成为更昔洛韦而发挥抗疱疹病毒作用的药物是伐更昔洛韦（E对）。伐更昔洛韦（VGCV）为更昔洛韦的前药，口服后在肠道和肝脏中水解成为更昔洛韦，发挥相同的抗病毒作用，其口服生物利用度是更昔洛韦的10倍，与更昔洛韦静脉滴注的生物利用度相近。昔多福韦（A错）为开环核甘酸类似物，在细胞胸苷激酶作用下转化为单磷酸酯、二磷酸酯和磷酸胆碱的生成物，对CMV的DNA聚合酶产生抑制。喷昔洛韦（B错）为核苷类抗病毒药，体外对Ⅰ型和Ⅱ型单纯疱疹病毒有抑制作用，在病毒感染的细胞中，病毒胸腺嘧啶脱氧核苷激酶将喷昔洛韦磷酸化为喷昔洛韦单磷酸盐，然后细胞激酶将喷昔洛韦单磷酸盐转化为喷昔洛韦三磷酸盐。核苷类抗疱疹病毒药物伐昔洛韦（C错）为阿昔洛韦的L-缬氨酸酯，属前药，口服后在肝脏水解为阿昔洛韦而发挥抗疱疹病毒作用。泛昔洛韦（D错）在体内迅速转化为有抗病毒活性的化合物喷昔洛韦，后者对Ⅰ型单纯疱疹病毒（HSV-1），Ⅱ型单纯疱疹病毒（HSV-2）以及水痘带状单纯疱疹病毒（VZV）有抑制作用。